患者，男，50岁，痛风缓解期，复查血尿酸为560μmol/L，尿液pH值为6.5，分型诊断为尿酸排泄障碍，此时宜使用的促尿酸排泄药是
A. 非布司他
B. 碳酸氢钠
C. 别嘌醇
D. 秋水仙碱
E. 苯溴马隆

正确答案：E。苯溴马隆

解析：本题考查苯溴马隆。该患者宜使用的促尿酸排泄药是苯溴马隆（E对）。痛风的药物治疗应按照临床分期进行，并遵循个体化原则。痛风慢性期应长期（乃至终身）抑制尿酸合成，并合用促进尿酸排泄药（促使尿酸通过肾脏排泄的苯溴马隆和丙磺舒）。非布司他（A错）为抗痛风药，用于痛风患者高尿酸血症的长期治疗。碳酸氢钠（B错）为抗酸药，用于治疗代谢性酸中毒、碱化尿液等，也可作为制酸药，治疗胃酸过多引起的症状。痛风缓解期在关节炎症控制后1～2周开始抑酸药别嘌呤（C错）治疗，以控制血尿酸水平，预防急性关节炎复发。痛风急性发作期应首选非甾体抗炎药（阿司匹林及水杨酸钠禁用）和秋水仙碱（D错）。